毒物能否通过完整皮肤进入体内，取决于其理化性质
A. 水溶性大
B. 水溶性小
C. 脂溶性小
D. 脂、水双溶性，脂水分配系数越接近于1越容易通过
E. 分散度越小越容易通过

正确答案：D。脂、水双溶性，脂水分配系数越接近于1越容易通过